患者，女性，25岁。平素易患咽炎，扁桃体炎，近来不规则低热3个月，膝、踝关节红、肿、热、痛明显，小腿有散在红斑，心肺（﹣），WBC增多，患慢性迁延性肝炎多年，不宜选用的药物是
A. 氢化可的松
B. 泼尼松
C. 泼尼松龙
D. 阿司匹林
E. 布洛芬

正确答案：B。泼尼松